心绞痛患者采取的体位
A. 强迫坐位
B. 辗转体位
C. 强迫蹲位
D. 强迫停立位
E. 强迫侧卧位

正确答案：D。强迫停立位

解析：心绞痛患者表现为胸痛，常为压迫、发闷或紧缩性，可有烧灼感，偶伴濒死的恐惧感觉，发作时患者常被迫立刻站住（D对），并以右手按抚心前部位，待症状稍缓解后才持续行走。强迫坐位（A错）亦称端坐呼吸，该体位便于辅助呼吸肌参与呼吸运动，加大膈肌活动度，增加肺通气量，并减少回心血量减轻心脏负荷，常见于心肺功能不全的患者；辗转体位（B错）患者辗转反侧，坐卧不安，见于胆石症、胆道蛔虫症、肾绞痛等；强迫蹲位（C错）见于先天性发绀型心脏病；强迫侧卧位（E错）多见于有胸膜疾病的患者，如一侧胸膜炎和大量胸腔积液等，可限制患侧胸廓活动而减轻疼痛和有利于健侧代偿呼吸。